关于维生素A醋酸酯的说法，错误的是
A. 维生素A醋酸酯化学稳定性比维生素A好
B. 维生素A醋酸酯对紫外线稳定
C. 维生素A醋酸酯易被空气氧化
D. 维生素A醋酸酯对酸不稳定
E. 维生素A醋酸酯长期储存时，会发生异构化，使活性下降

正确答案：B。维生素A醋酸酯对紫外线稳定

解析：本题考查维生素A醋酸酯的性质。维生素A醋酸酯是一种脂溶性维生素，对热、酸、碱稳定，易被氧化，紫外线可促进其氧化破坏（B错，为本题正确答案）。